下列除哪项外，均是中风闭证的特点
A. 突然昏仆
B. 牙关紧闭
C. 口噤不开
D. 肢体强痉
E. 二便自遗

正确答案：E。二便自遗

解析：中风闭证为邪气内闭清窍所致，有阳闭和阴闭之分，阳闭者，因清窍闭塞，故突然昏仆，风火、痰火灼筋致筋脉拘急，故见肢体强痉，口噤不开，牙关紧闭，两手握固，热结阳明，腑气不通，故见大便秘结，而二便自遗为中风脱证的表现（ABCD错E对）。